关于大气二次污染物的说法，不正确的是
A. 经化学或光化学作用生成
B. 与一次污染物的化学性质不同的新污染物
C. 毒性往往比一次污染物更大
D. 光化学烟雾是二次污染物
E. 沉降的污染物因刮风再次进入大气是二次污染物

正确答案：E。沉降的污染物因刮风再次进入大气是二次污染物

解析：从污染源直接排出的一次污染物，在大气中受到化学作用或光化学作用（A对），本身产生了化学变化（B对），转变成毒性比一次污染物更大的化学物质（C对），即为二次污染物。光化学烟雾为大气中的 NOx、VOCs受强烈太阳紫外线作用，发生光化学反应所产生的一种刺激性很强的浅蓝色混合烟雾，属于二次污染物（D对）。沉降的污染物因刮风再次进入大气是二次污染，这句话本身是对的，但是沉降的污染物因刮风再次进入大气，污染物本身没有发生化学变化，不属于大气二次污染物（E错，为本题正确答案）。